下列开展健康促进学校的有效措施需要特别突出的是
A. 选择解决健康问题的适宜突破口
B. 发挥学校自身拥有的潜力
C. 发动学校师生以实际行动改善学校环境
D. 加强与学校周边组织、机构的联系，共同为学生的健康成长服务
E. 突出健康促进学校的政府行为

正确答案：E。突出健康促进学校的政府行为